男，7岁，突发寒战，髙热，右膝下方剧痛3天，查体T39.8℃，P86次/分，R25次/分，BP110/60mmHg。烦躁不安，右膝关节呈半屈曲状，拒动，右小腿近端皮温高，肿胀不明显，压痛阳性。诊断明确后首选的处理措施
A. 足量抗生素
B. 物理降温
C. 支持治疗
D. 手术
E. 肢体制动

正确答案：A。足量抗生素

解析：以往急性血源性骨髓炎死亡率高，由于应用了抗生素，死亡率已明显下降。如早期得不到正确诊断与治疗，往往演变为慢性骨髓炎，早期诊断与正确治疗是关键。故对疑有骨髓炎者应立即开始足量抗生素治疗（A对），在发病5天内使用往往可以控制炎症，而在5天后使用或细菌对抗生素不敏感时，都会影响疗效。物理降温（B错）、支持治疗（C错）、肢体制动（E错）均为辅助治疗，不应作为首选处理措施；2.手术治疗（D错）多用于在抗生素治疗后48-72小时仍不能控制局部症状时进行。